通过血行播散引起的原发性腹膜炎致病菌主要是
A. 变形杆菌
B. 大肠埃希菌
C. 肺炎链球菌
D. 铜绿假单胞杆菌
E. 拟杆菌

正确答案：C。肺炎链球菌

解析：原发性腹膜炎又称自发性腹膜炎，指腹腔内无原发疾病或感染病灶存在而发生的细菌性腹膜炎，其主要感染途径有血行播散、上行性感染、直接扩散和透壁性感染，致病菌（七版黄家驷外科学P1352）多为溶血性链球菌和肺炎双球菌，少数为大肠杆菌（B错）、克雷伯杆菌和淋球菌。经血行播散引起的原发性腹膜炎致病菌主要是肺炎链球菌（肺炎双球菌）（C对）。变形杆菌（A错）、铜绿假单胞杆菌（D错）和拟杆菌（E错）是引起继发性腹膜炎的常见致病菌。